Allen试验主要用于检查
A. 手部肌腱损伤情况
B. 手指末端血运情况
C. 神经损伤后的恢复情况
D. 手部神经损伤程度
E. 桡尺动脉的通畅和相互吻合情况

正确答案：E。桡尺动脉的通畅和相互吻合情况

解析：Allen试验用于检查桡尺动脉的通畅和相互吻合情况（E对）。具体步骤如下：①嘱患者用力握拳，检查者两手拇指用力分别按压阻断手腕与前臂交界处的尺、桡动脉②让病人手掌放松、伸指，此时手掌部苍白，然后放开尺动脉，观察手掌颜色③重复上述试验，放开桡动脉，观察手掌颜色。若手掌颜色5s之内迅速变红或恢复正常，即Allen试验阴性，表明尺动脉和桡动脉间存在良好的侧支循环，可以行动脉穿刺；相反，若5s手掌颜色仍为苍白，即Allen试验阳性，这表明手掌侧支循环不良。禁做做介入、动静脉内瘘等手术。手部肌腱损伤情况（A错）主要通过检查手指的屈伸运动能否。手指末端血运情况（B错）主要通过检查手指末端颜色、温度、毛细血管搏动情况等。手部神经损伤后的恢复情况（C错）及手部神经损伤程度（D错）主要通过检查手部的运动和感觉。